属于医务人员自我道德评价方式的是
A. 慎独
B. 内心信念
C. 传统习俗
D. 监督
E. 社会舆论

正确答案：B。内心信念

解析：在实践中，医德评价的方式是多种多样的，总结起来说主要有三种，即社会舆论，传统习俗和内心信念（B对）。